地塞米松的禁忌证是
A. 抑郁症
B. 支气管哮喘
C. 荨麻疹
D. 心绞痛
E. 活动性消化性溃疡

正确答案：E。活动性消化性溃疡

解析：本题考查地塞米松的禁忌证。地塞米松的禁忌证是活动性消化溃疡（E对）。地塞米松为糖皮质激素，糖皮质激素的禁忌证：①严重精神病或癫痫病史者、活动性消化性溃疡病或新近胃肠吻合术者、骨折患者、创伤修复期患者、角膜溃疡者、肾上腺皮质功能亢进者、严重高血压、糖尿病患者。②妊娠早期妇女。③抗菌药物不能控制的水痘、真菌感染者。④未能控制的结核、细菌和病毒感染者。